具有行气解郁清热功用的方剂是
A. 越鞠丸
B. 半夏厚朴汤
C. 厚朴温中汤
D. 旋覆代赭汤
E. 天台乌药散

正确答案：A。越鞠丸

解析：越鞠丸方含香附辛香入肝，行气解郁为君药，以治气郁；栀子苦寒清热泻火，以治火郁，故具有行气解郁清热之功（A对）。越鞠丸还含川芎辛温入肝胆，为血中气药，既可活血祛瘀治血郁，又可助香附行气解郁；苍术辛苦性温，燥湿运脾，以治湿郁；神曲味甘性温入脾胃，消食导滞，以治食郁。故越鞠丸可行气、清热、活血、祛痰湿、消食，以行气为主，主治气、血、痰、火、湿、食六郁之证。半夏厚朴汤功用为行气散结，降逆化痰，主治梅核气（B错）。厚朴温中汤功用为行气除满，温中燥湿，主治脾胃寒湿气滞证（C错）。 旋覆代赭汤功用为降逆化痰，益气和胃，主治胃虚痰阻气逆证（D错）。天台乌药散功用为行气疏肝，散寒止痛，主治肝经气滞寒凝证（E错）。